下列关于烫伤救治措施的说法，正确的是
A. 创面及时外涂甲紫溶液预防感染
B. Ⅰ度烫伤可冷敷后外涂烧伤膏
C. 可用清洁塑料薄膜覆盖创面，以防创面感染
D. 烫伤患者的镇痛、镇静药物首选氯丙嗪
E. 失水较多的患者应多饮白开水或无盐饮料

正确答案：B。Ⅰ度烫伤可冷敷后外涂烧伤膏

解析：本题考查烫伤救治措施。下列关于烫伤救治措施的说法，正确的是Ⅰ度烫伤可冷敷后外涂烧伤膏（B对）。对局部较小面积轻度烫伤，可在家中施治：在清洁创面后，外涂京万红软膏、（美宝）润湿烧伤膏等。镇痛、镇静：轻伤员可口服止痛片或肌注哌替啶、吗啡等，重伤员多采用静脉滴注哌替啶或与异丙嗪合用（D错）。伴有脑外伤的患者可使用地西泮。烫伤后可用纱布、三角巾、中单或清洁被单、衣服等进行简单包扎。切忌用塑料布包扎或覆盖创面，因其不透气，可致使创面发生浸渍而加速感染（C错）。创面不可涂有颜色的药物，如汞溴红（红汞）、甲紫，以免影响后续治疗中清创和对创面深度的判断（A错）。轻至中度烫伤可口服“烧伤饮料”或含盐饮料，重度烫伤应予以静脉补液（E错）。